在前伸咬合的过程中，最重要和最易重复的（牙合）是
A. 牙尖交错（牙合）
B. 反（牙合）
C. 锁（牙合）
D. 反锁（牙合）
E. 对刃（牙合）

正确答案：E。对刃（牙合）

解析：当下颌由牙尖交错（牙合）位依切导向前、下运动的过程中，上下牙列间的咬合关系皆为前伸（牙合）关系。在前伸咬合的过程中，最重要和最易重复的（牙合）是对刃（牙合）。对刃（牙合）是一个重要的（牙合）关系，前牙切咬食物时达到切缘相对，切断食物。掌握“牙尖交错（牙合）、前伸（牙合）及侧（牙合）”知识点。